对医患之间信托关系的正确理解是
A. 陌生人关系
B. 不同于一般陌生人关系
C. 类似于陌生人关系
D. 父子关系
E. 主动-被动关系

正确答案：B。不同于一般陌生人关系

解析：医患信托关系是医务人员和医疗机构受患者的信任和委托，保障患者在医疗活动中的健康利益不受损害并有所促进的一种关系。医患关系不同于一般的法律合同关系、单纯的契约关系，它要以医患间的真诚信任为基础，而不是完全依靠法律的外在约束。掌握“医患关系伦理”知识点。